下列恶性肿瘤中，应用化疗疗效最好的是
A. 肝癌
B. 子宫内膜癌
C. 睾丸精原细胞癌
D. 胃癌
E. 肾母细胞癌

正确答案：C。睾丸精原细胞癌

解析：化学治疗是肿瘤的主要治疗手段之一。目前，部分肿瘤单独应用化疗即可治愈，如绒毛膜上皮癌、恶性葡萄胎、睾丸精原细胞瘤、Burkitt淋巴瘤、大细胞淋巴瘤等。因此，应用化疗疗效最好的是睾丸精原细胞癌（C对）。肝癌（A错）以手术切除为主要治疗方法，对化疗不敏感，仅作为术前或术后的辅助治疗。子宫内膜癌（九版妇产科学P309）（B错）以手术治疗为首选的治疗方法，化疗效果不佳，可作为晚期或复发子宫内膜癌综合治疗措施之一。胃癌的化疗可用于根治性手术的术前、术中和术后，以延长生存期（D错）。肾母细胞癌（E错）经化疗可获得长期缓解，但效果不及睾丸精原细胞瘤。